支原体肺炎应用抗生素的疗程应是
A. 体温正常后停药
B. 症状基本消失后
C. 1周
D. 2～3周
E. 4～6周

正确答案：D。2～3周

解析：抗生素用药时间应持续至体温正常后5～7日（A错）；临床症状基本消失后3天（B错），支原体肺炎至少用药2～3周（D对CE错），以免复发。葡萄球菌肺炎比较顽固，易于复发及产生并发症，疗程宜长，一般于体温正常后继续用药2～3周，总疗程6周。